细胞内外渗透压的平衡主要靠哪一种物质的移动来维持？
A. Na⁺
B. K⁺
C. 葡萄糖
D. 蛋白质
E. 水

正确答案：E。水

解析：细胞内外渗透压主要取决于电解质的浓度，葡萄糖（C错）、蛋白质（D错）所产生的渗透压极小，离子（AB错）的转移需借助细胞膜上离子通道蛋白，水可以自由通过细胞膜，故渗透压改变时主要靠水（E对）的移动来维持。